首先提出“重阳者狂，重阴者癫”的古典文献是
A. 《内经》
B. 《难经》
C. 《金匮要略》
D. 《中藏经》
E. 《类经》

正确答案：B。《难经》

解析：首先提出“重阳者狂，重阴者癫”的古典文献是《难经》（B对）。癫狂病名首见于《黄帝内经》（A错）。《金匮要略·五脏风寒积聚病脉证并治》云：“邪哭使魂魄不安者，血气少也…阴气衰者为癫，阳气衰者为狂”，提出心虚而血气少，阴气病则为癫，阳气病则为狂（C错）。